关于谵妄病人的说法，正确的是
A. 会发生冲动行为但不会有自伤
B. 常有恐怖性的视幻觉但内容常模糊不清
C. 主要是意识范围障碍
D. 不会产生被害妄想
E. 突然变得安静，说明病情可能加剧

正确答案：C。主要是意识范围障碍

解析：谵妄是一组表现为急性、一过性、广泛性的认知障碍，尤以意识障碍（C对）为主要特征。谵妄是在意识清晰度下降的同时，表现有定向力障碍，包括时间、地点、人物定向力及自身认识障碍，并产生大量的幻觉、错觉，幻觉以幻视多见，内容多为生动、逼真而鲜明的形象（B错），如看到猛兽、鬼神、战争场面等。